与饮用水硬度过高有关的健康影响是
A. 贫血
B. 高血压
C. 肠胃功能紊乱
D. 龋齿
E. 牙斑

正确答案：C。肠胃功能紊乱

解析：本题考查饮用水的硬度。饮用硬度高的水可引起胃肠功能暂时性紊乱（C对ABDE错）。据国内报道饮用总硬度为707～935mg/L（以碳酸钙计）的水，次日就可出现腹胀、腹泻和腹痛等症状。此外，硬水易形成水垢，对日常生活产生影响。